患者女性24岁，拔除近中阻生齿后3天出现吞咽疼痛，张口受限，检查见拔牙创血块存在，舌侧黏膜红肿，压痛明显，此患者最大可能是
A. 干槽症
B. 咽颊前间隙感染
C. 舌侧骨板断裂
D. 舌神经损伤
E. 牙槽突骨折

正确答案：B。咽颊前间隙感染

解析：本题考查拔牙术后感染-咽颊前间隙感染。咽颊前间隙感染（B对）时咽喉部会有红肿热痛和功能障碍，可出现吞咽疼痛，张口受限，舌侧黏膜红肿和明显压痛，该患者符合此症状，这是最可能的诊断。干槽症（A错）表现为拔牙创疼痛剧烈，检查会见拔牙窝空虚，伴腐败性臭味，而该患者拔牙创血块存在。舌侧骨板断裂（C错）表现为骨动度异常；舌神经损伤（D错）表现为舌前2/3味觉异常；牙槽突骨折（E错）表现为咬合使牙随骨折段活动。